可用于治疗或预防各类抑郁症的药物是
A. 奥氮平
B. 舍曲林
C. 奋乃静
D. 氯丙嗪
E. 帕罗西汀

正确答案：B。舍曲林

解析：本题考查舍曲林。可用于治疗或预防各类抑郁症的药物是舍曲林（B对）。舍曲林可用于治疗抑郁症和预防发作。奥氮平（A错）、奋乃静（C错）、氯丙嗪（D错）均可用于治疗精神分裂症。帕罗西汀（E错）用于抑郁症、强迫症、惊恐障碍及社交恐惧症等。